患者，男，60岁。因发热咳嗽，而出现小便不畅，点滴不爽，烦渴欲饮，呼吸急促，舌红苔薄白，脉数。其病机是
A. 肾元亏虚
B. 湿热蕴结
C. 脾气不升
D. 肺热壅盛
E. 气机阻滞

正确答案：D。肺热壅盛

解析：肺热壅盛，失于肃降，不能通调水道，下输膀胱，故小便不畅，点滴不爽；肺热上壅，故烦渴欲饮，呼吸急促；舌红苔薄白，脉数，为肺热壅盛之征（D对）。肾元亏虚证（A错）的特点为小便不通，或点滴不爽，排出无力，或面色不华，精神疲惫，畏寒肢冷，腰膝酸软无力。湿热蕴结证（B错）的特点为小便点滴不通，或量极少而短赤灼热，小腹胀满，口苦口黏，或口渴不欲饮，或大便不畅。脾气不升证（C错）的特点为小腹坠胀，时欲小便而不得出，或量少而不畅，精神疲惫，食欲不振。气机阻滞证（E错）的特点为小便不通或通而不畅，情志抑郁，或烦躁易怒，胁腹胀满。